小于胎龄儿、适于胎龄儿与大于胎龄儿
A. 根据胎龄分类
B. 根据出生体重分类
C. 根据体重与胎龄关系分类
D. 根据出生同龄分类
E. 根据出生后情况分类

正确答案：C。根据体重与胎龄关系分类

解析：本题考查体重与胎龄的关系分类。根据出生体重与胎龄关系分类（C对ABDE错）：1.适于胎龄儿是新生儿的出生体重在同胎龄平均出生体重的第10～90百分位之间；2.小于胎龄儿是新生儿出生体重在同胎龄平均出生体重的第10百分位以下；3.大于胎龄儿时新生儿出生体重在同胎龄平均出生体重的第90百分位以上。